诊断休克的主要依据是
A. 临床表现
B. 脉率变快
C. 血压下降
D. 动脉氧分压60mmHg
E. 尿少

正确答案：A。临床表现

解析：休克的诊断关键是及时发现早期临床症状。凡是遇到严重损伤、大量出血、重度感染以及过敏病人和有心脏病病史者，应该想到并发休克的可能；临床观察中对于有出汗、兴奋、心率加快、脉压小或尿少等症状者，应疑有休克。若病人出现神智淡漠、反应迟钝、皮肤苍白、呼吸浅快、收缩压降至90mmHg以下及尿少者，则标志病人已经进入休克抑制期。掌握“休克”知识点。